尖锐湿疣最常见的传播途径是
A. 血液传播
B. 性传播
C. 接触传播
D. 胎盘传播
E. 经产道传播

正确答案：B。性传播

解析：本题考查尖锐湿疣的传播方式。尖锐湿疣的主要的传播途径是性接触传播（B对ACDE错），在分挽过程中胎儿经过患尖锐湿疣母亲的产道或生后与患病的母亲密切接触而受染。婚育指导和医学意见为暂缓结婚。经治疗去除疣体后建议观察6个月左右，如无复发可考虑婚育为宜。